关于急性失血患者的输血，正确提法是
A. 用等量的全血补充所估计的失血量
B. 在晶体液胶体液扩容的基础上，适当输注全血
C. 在晶体液胶体液扩容的基础上，合理输血（主要是输红细胞）
D. 先输注血浆补充血容量，再输注红细胞纠正贫血
E. 红细胞、新鲜冰冻血浆及血小板三者合理搭配输注

正确答案：C。在晶体液胶体液扩容的基础上，合理输血（主要是输红细胞）

解析：急性失血患者应立即输注晶体液、胶体液扩容，防治休克，保证各器官灌注，再合理输注红细胞，提高血液携氧能力（C对）。全血中成分较多，易引发输血反应、造成浪费，现已极少应用（AB错）。输血（包括各种血制品）前，为防止出现输血反应，需进行严格配血试验，若一味等待可能会导致病人失血过多而休克甚至死亡（DE错）。